用水蒸气蒸馏法提取的中药化学成分在水中的溶解性是
A. 极易解
B. 易溶
C. 可溶
D. 微溶
E. 难溶

正确答案：E。难溶

解析：本题考查的是水蒸气蒸馏法。水用水蒸气蒸馏法提取的中药化学成分在水中的溶解性是难溶（E对）。水蒸气蒸馏法：适用于具有挥发性的、能随水蒸气蒸馏而不被破坏，且难溶或不溶于水的化学成分的提取。此类化合物的沸点多在100℃以上，并在100℃左右有一定的蒸气压。